气瘿的内治法是
A. 疏肝解郁，化痰软坚
B. 化痰软坚、开郁行瘀
C. 疏肝理气，解郁消肿
D. 疏风清热，化痰散结
E. 疏肝健脾，化痰散结

正确答案：A。疏肝解郁，化痰软坚

解析：气瘿，是瘿病的一种，因其患部肿块柔软无痛，可随喜怒而消长，故称为气瘿，外因系平素饮水或食物中含碘不足；内因为情志不畅，忧怒无节，气化失调，升降障碍，营运阻塞，治疗一般采用内治法，宜疏肝解郁，化痰软坚为主（A对）。